以甘油明胶为基质的栓剂制备时，润滑剂宜选用
A. 肥皂醑
B. 甘油
C. 植物油
D. 稀硫酸
E. 不同浓度的乙醇

正确答案：C。植物油

解析：本题考查的是栓剂的润滑剂。以甘油明胶为基质的栓剂制备时，润滑剂宜选用植物油（C对）。制备栓剂时，润滑剂的选用：油溶性基质采用水溶性润滑剂，水溶性基质采用油脂性润滑剂。甘油明胶系用明胶、甘油与水制成，一般明胶与甘油等量，水应控制在10%以下。甘油明胶是水溶性基质选择油脂性润滑剂，如植物油。增塑剂：能使制得的膜柔软并具有一定的抗拉强度。常用的有甘油（B错）、乙二醇、山梨醇等。流浸膏剂与浸膏剂有以水为溶剂制备而成和以乙醇为溶剂制备而成之分，其中大多以不同浓度的乙醇为溶剂，以水为溶剂者较少。以水为溶剂的流浸膏剂中可酌加20%～25%的乙醇（E错）为防腐剂。